某单位为吸烟者开辟一间吸烟室，属于
A. 政策策略
B. 教育策略
C. 环境策略
D. 资源策略
E. 人才策略

正确答案：C。环境策略